血管内皮细胞分泌增多而导致血压下降的是
A. 前列腺素
B. 肾素
C. 血管紧张素
D. 内皮素
E. 前列环素

正确答案：E。前列环素